影响体内外钾平衡调节的主要激素是
A. 胰岛素
B. 胰高血糖素
C. 肾上腺糖皮质激素
D. 醛固酮
E. 甲状腺素

正确答案：D。醛固酮

解析：醛固酮（D对）能够加强肾保钠保水排钾作用，醛固酮分泌增多会导致低钾血症。胰岛素（A错）、胰高血糖素（B错）、肾上腺糖皮质激素（C错）、甲状腺素（E错）对钾代谢无明显影响。